患者，女，32岁。左臀部出现硬结，红热不显，有触痛，步行不便，有患部肌肉注射史。应首先考虑的是
A. 无头疽
B. 有头疽
C. 臀痈
D. 痈
E. 肉瘤

正确答案：C。臀痈

解析：无漫肿，疼痛，排除无头疽（A错）。无脓头，无溃烂，不是有头疽（B错）。有肌肉注射史，难于起发，诊断为臀痈（C对）。痈特点是局部光软无头，红肿疼痛，本例红热不显，可排除（D错）。肉瘤特点是软似绵，肿似馒，皮色不变，不紧不宽，如肉之隆起，与该题之硬结，有触痛不符（E错）。